艾滋病传播途径的预防教育内容不包括
A. 性传播预防教育
B. 消化道传播预防教育
C. 血液传播预防教育
D. 母婴传播预防教育
E. 吸毒与感染艾滋病病毒的关系及其危险性教育

正确答案：B。消化道传播预防教育